关于去甲肾上腺素不良反应及禁忌证的说法不正确的是
A. 可引起局部组织缺血坏死
B. 高血压患者禁用
C. 动脉硬化患者禁用
D. 不良反应中无急性肾衰竭
E. 孕妇禁用

正确答案：D。不良反应中无急性肾衰竭

解析：去甲肾上腺素的不良反应有：局部组织缺血坏死、急性肾衰竭。因为能够引起宫缩频率增加，故其禁忌证为高血压、动脉硬化症，器质性心脏病及少尿、无尿、严重微循环障碍的患者及孕妇禁用。掌握“去甲肾上腺素”知识点。